急性尿潴留病因中，属于机械性梗阻的是
A. 使用阿托品普鲁卡因等药物后
B. 脊髓性高位截瘫
C. 直肠术后
D. 前列腺肥大
E. 外伤性高位截瘫

正确答案：D。前列腺肥大

解析：尿潴留的病因可分为机械性梗阻和动力性梗阻。其中机械性梗阻最多见，包括良性前列腺增生（即前列腺肥大）（D对）、前列腺肿瘤、膀胱颈挛缩、各种原因引起的尿道狭窄、肿瘤和尿道结石等。脊髓性或外伤性高位截瘫（BE错）、马尾损伤、直肠（C错）肛管手术后、腰麻术后以及使用阿托品、普鲁卡因等药物后（A错）均为动力性梗阻因素。